肝性脑病前驱期的主要表现是
A. 性格改变
B. 计算能力减退
C. 定向力减退
D. 巴宾斯基（Babinski）征阳性
E. 生理反射亢进

正确答案：A。性格改变

解析：肝性脑病主要表现为高级神经中枢的功能紊乱以及运动和反射异常，其临床表现主要分为5期，0期（潜伏期）、1期（前驱期）、2期（昏迷前期）、3期（昏睡期）及4期（昏迷期）。其中，肝性脑病前驱期的主要表现为焦虑、淡漠及健忘等轻度性格改变（A对）及精神异常。计算能力减退（B错）为肝性脑病潜伏期（0期）的主要表现。定向力减退（C错）和巴宾斯基（Babinski）征阳性（D错）为肝性脑病昏迷前期（2期）的主要表现。生理反射亢进（E错）为肝性脑病昏迷前期（2期）、昏睡期（3期）、昏迷期（4期）的主要表现。